六味地黄汤合黄连阿胶汤适用于甲状腺功能亢进症的哪种证型
A. 心肝阴虚
B. 心肾阴虚
C. 心脾两虚
D. 肝火亢盛
E. 痰热瘀阻

正确答案：B。心肾阴虚

解析：六味地黄丸的功效为滋阴补肾，主治肾阴虚证；黄连阿胶汤功效为滋阴降火安神，用于治疗心肾不足，阴虚火旺较重的心烦失眠，主要滋补心阴，故六味地黄汤合黄连阿胶汤适用于甲状腺功能亢进症的心肾阴虚证（B对）。心肝阴虚证（A错）不属于甲状腺功能亢进症的证型。心脾两虚证（C错）治法为健脾养心，益气养血，方药选归脾汤加减。肝火亢盛证（D错），治疗需要清肝泻火，方药用龙胆泻肝汤加减。痰热瘀阻证（E错）治疗需要清热化痰，活血化瘀，可用海藻玉壶汤加减。